分泌雌激素的卵巢恶性肿瘤是
A. 未成熟型畸胎瘤
B. 浆液性囊腺癌
C. 子宫内膜样癌
D. 颗粒细胞瘤
E. 原发性绒癌

正确答案：D。颗粒细胞瘤

解析：分泌雌激素的卵巢恶性肿瘤是颗粒细胞瘤（D对）。病理上颗粒细胞瘤分为成人型和幼年型，其中成年型颗粒细胞瘤为低度恶性肿瘤，能分泌雌激素，可引起性早熟、月经紊乱及绝经后阴道不规则流血。原发性绒癌（E错）即原发性卵巢绒癌（八年制第2版妇产科学P350）能分泌hCG。未成熟型畸胎瘤（A错）属于卵巢生殖细胞肿瘤、浆液性性囊腺癌（B错）和子宫内膜样癌（C错）属于卵巢上皮性肿瘤，三者均为卵巢恶性肿瘤，但是都不能分泌雌激素。